用于盖髓的氢氧化钙制剂的pH值
A. 6.5～7.5
B. 8～9
C. 9～12
D. 12～14
E. 14

正确答案：C。9～12

解析：本题考查氢氧化钙制剂的pH值。盖髓剂指覆盖于接近牙髓的牙本质表面或已暴露的牙髓创面上，使牙髓组织恢复活力的制剂。氢氧化钙是最具疗效的盖髓剂，呈碱性，pH9～12（C对），可中和炎症所产生的酸性产物，有利于消除炎症和减轻疼痛。用于盖髓的氢氧化钙制剂的pH值不能太小如6.5～7.5（A错）、8～9（B错）不能完全中和炎症所产生的酸性产物。也不能太大如12～14（D错）、14（E错），pH太大呈强碱性会损伤牙髓组织。